初产妇，32岁。剖宫产一男活婴，产后1周，寒战高热，左下肢持续性疼痛1天，恶露量多，头晕，乏力，体温39.5℃，脉搏120次/分，血压110/70mmHg，此病人最可能的诊断是
A. 子宫肌炎
B. 盆腔结缔组织炎
C. 血栓性静脉炎
D. 盆腔静脉炎
E. 败血症

正确答案：C。血栓性静脉炎

解析：患者为初产妇，产后1周出现寒战高热、头晕、乏力恶露量多血栓性静脉炎的主要临床表现为产后1～2周多见，寒战、高热，恶露量多，发生下肢血栓静脉炎时，出现下肢持续性疼痛，根据患者的临床表现和实验室检查，最可能的诊断是盆腔血栓性静脉炎（C对D错）。急性子宫肌炎主要临床表现为发热、腹痛、腰骶酸痛、阴道分泌物增多、下腹下坠感等；慢性子宫肌炎主要临床表现为下腹隐痛、月经不规则等，多由急性子宫肌炎转化而来，由于患者无以上症状，因此不考虑子宫肌炎（A错）。盆腔结缔组织炎（P227）（B错）的主要临床表现为寒战高热、下腹痛，妇科检查时发现患者宫颈举痛，宫体增大、压痛明显且受累的附件区有明显增厚。败血症（P228）（E错）常表现为持续高热、寒战、全身明显中毒症状，可危及生命。